伤寒发病2周，微生物学检查分离培养时常采取的标本是
A. 骨髓
B. 血液
C. 尿
D. 便
E. 十二指肠液

正确答案：D。便